HIV造成机体免疫功能损害主要侵犯的细胞是
A. CD4+T 细胞
B. CD8+T 细胞
C. B淋巴细胞
D. NK细胞
E. 浆细胞

正确答案：A。CD4+T 细胞

解析：HIV直接和间接侵犯、破坏CD4+T淋巴细胞，使CD4+T淋巴细胞功能受损和大量破坏，导致细胞免疫缺陷，故HIV造成机体免疫功能损害主要侵犯的细胞是CD4+T 细胞（A对B错）。HIV同时还可侵犯其他类型免疫细胞：单核吞噬细胞、B淋巴细胞（CE错）、NK细胞（D错）及HIV感染后的免疫应答细胞等，但均不是HIV造成机体免疫功能损害主要侵犯的细胞。